《药品经营质量管理规范》的英文缩写是
A. GMP
B. GLP
C. GCP
D. GSP
E. GAP

正确答案：D。GSP

解析：本题考查的是《药品经营质量管理规范》。《药品经营质量管理规范》的英文缩写是GSP（D对）。《药品经营质量管理规范》（GSP）是药品经营管理和质量控制的基本准则，其目的是通过药品流通的全过程质量管理，规范药品经营行为，保障人体用药安全、有效。从事药品生产活动，应当遵守药品生产质量管理规范，建立健全药品生产质量管理体系，保证药品生产全过程持续符合法定要求。按照新《药品管理法》发布实施之前的规定，新开办药品生产企业或药品生产企业新增生产范围、新建车间的，应当按照《药品管理法实施条例》的规定，自取得生产证明文件或经批准正式生产之日起30日，按照规定要求申请药品《药品生产质量管理规范》（GMP）（A错）认证。药物非临床研究质量管理规范（GLP）（B错）：非临床安全性评价研究，指为评价药物安全性，在实验室条件下用实验系统进行的试验，初步目的是通过毒理学试验对受试物的毒性反应进行暴露，在非临床试验中提示受试物的安全性。非临床安全性评价研究的内容包括安全药理学试验、单次给药毒性试验、重复给药毒性试验、生殖毒性试验、遗传毒性试验、致癌性试验、局部毒性试验、免疫原性试验、依赖性试验、毒代动力学试验以及与评价药物安全性有关的其他试验。药物临床试验质量管理规范（GCP）（C错）：药物临床试验包括新药临床试验（含生物等效性试验）和上市后的Ⅳ期临床试验。为保证药物研究实验记录真实、及时、准确、完整，提高药物临床试验质量，保障受试者的合法权益，药物临床试验实行过程管理；药物临床试验必须实施《药物临床试验质量管理规范》；并执行《药品研究实验记录暂行规定》《药品临床研究若干规定》等相关规定。《中药材生产质量管理规范》（GAP）（E错）是中药材生产和质量管理的基本准则，适用于中药材生产企业生产中药材（含植物、动物药）的全过程。